免疫球蛋白的超变区在
A. Fab
B. Fe
C. 绞链区
D. CH1区
E. CH2区

正确答案：A。Fab